在经典、替代两个途径中均起作用的补体成分是
A. C1δ
B. C1γ
C. C2
D. C3
E. C4

正确答案：D。C3